表面有“砂眼”，根头具“珍珠盘”的中药材是
A. 玉竹
B. 地黄
C. 柴胡
D. 银柴胡
E. 西洋参

正确答案：D。银柴胡

解析：本题考查的是银柴胡药材的性状鉴别。表面有“砂眼”，根头具“珍珠盘”的中药材是银柴胡（D对）。银柴胡：【性状鉴别】药材呈类圆柱形，偶有分枝。表面浅棕黄色至浅棕色，有扭曲的纵皱纹及支根痕，多具孔穴状或盘状凹陷，习称“砂眼”，从砂眼处折断可见棕色裂隙中有细砂散出。根头部略膨大，有密集的呈疣状突起的芽苞、茎或根茎的残基，习称“珍珠盘”。质硬而脆，易折断，断面不平坦，较疏松，有裂隙，皮部甚薄，木部有黄、白色相间的放射状纹理。气微，味甘。玉竹（A错）：【性状鉴别】药材呈长圆柱形，略扁，少有分枝。表面黄白色或淡黄棕色，半透明，具纵皱纹和微隆起的环节，有白色圆点状须根痕和圆盘状茎痕。质硬而脆或稍软，易折断，断面角质样或显颗粒性。气微，味甘，嚼之发黏。地黄（B错）：【性状鉴别】药材鲜地黄呈纺锤形或条状。外皮薄，表面浅红黄色，具弯曲的纵皱纹、芽痕、横长皮孔样突起以及不规则疤痕。肉质、易断，断面皮部淡黄白色，可见橘红色油点，木部黄白色，导管呈放射状排列。气微，味微甜、微苦。柴胡（C错）：【性状鉴别】药材北柴胡呈圆柱形或长圆锥形，根头膨大，顶端有3～15个残留的茎基或短纤维状的叶基，下部分枝。表面黑褐色或浅棕色，具纵皱纹，支根痕及皮孔。质硬而韧，不易折断，断面呈片状纤维性，皮部浅棕色，木部黄白色。气微香，味微苦。西洋参（E错）：【性状鉴别】药材呈纺锤形、圆柱形或圆锥形。表面浅黄褐色或黄白色，可见横向环纹及线形皮孔状突起，并有细密浅纵皱纹及须根痕。主根中下部有一至数条侧根，多已折断。有的上端有根茎（芦头），环节明显，茎痕（芦碗）圆形或半圆形，具不定根（艼）或已折断。体重，质坚实，不易折断，断面平坦，浅黄白色，略显粉性，皮部可见黄棕色点状树脂道，形成层环纹棕黄色，木部略呈放射状纹理。气微而特异，味微苦、甘。